足太阴脾经的大包穴位于腋中线上的
A. 第3肋间隙
B. 第4肋间隙
C. 第5肋间隙
D. 第6肋间隙
E. 第7肋间隙

正确答案：D。第6肋间隙

解析：足太阴脾经的大包穴位于腋中线上的第6肋间隙（D对）。